胃破裂
A. 左肩放射性痛
B. 尿淀粉酶升高
C. 膈下游离气体
D. 腹膜后积气
E. 腹部外伤后直肠指检指套染血

正确答案：C。膈下游离气体

解析：胃破裂可出现膈下游离气体（C对），左肩放射性痛（A错）多见脾破裂；尿淀粉酶（B错）升高多见于急性胰腺炎；腹膜后积气（D错）见于十二指肠损伤；直肠破裂可出现腹部外伤后直肠指检指套染血（E错）。